咬紧患牙时疼痛有所缓解的病变为
A. 急性浆液性根尖周炎
B. 急性化脓性根尖周炎
C. 慢性化脓性根尖周炎
D. 根尖周肉芽肿
E. 根尖周囊肿

正确答案：A。急性浆液性根尖周炎

解析：本题考查急性浆液性根尖周炎。咬紧患牙时疼痛有所缓解的病变为急性浆液性根尖周炎（A对）。1.急性化脓性根尖周炎（B错）：（1）根尖周脓肿：患牙出现自发性、剧烈持续的跳痛，伸长感加重，以至于咬合时首先接触患牙并引起剧痛，患者因而不敢对合。（2）骨膜下脓肿：患牙的持续性、搏动性跳痛更加剧烈，因骨膜坚韧、致密，脓液集聚于骨膜下所产生的压力很大，病程至此，疼痛达到最高峰，病期多已三五日，患者感到极端痛苦。患牙更觉浮起、松动，即使是不经意地轻触患牙，如说话时舌、颊部碰触患牙，亦感觉疼痛难忍。患者常诉有因疼痛逐日加剧而影响睡眠和进食，还可伴有体温升高、身体乏力等全身症状。（3）黏膜下脓肿：由于黏膜下组织较疏松，脓液到达黏膜下时，压力已明显减低，自发性胀痛及咬合痛也随之减轻。全身症状缓解。2.慢性根尖周脓肿（C错）多无明显的自觉症状，部分患者有咀嚼不适或咀嚼痛。3.根尖肉芽肿多数无明显自觉症状，部分临床表现咀嚼乏力或不适，偶有疼痛，患牙多有较深的龋坏或由于牙髓坏死致牙冠变色和失去光泽。4.根尖周囊肿（E错）患牙常为深龋、死髓牙或残冠，有叩诊痛。可反覆出现急性炎症症状如局部肿胀、疼痛等，经治疗后可转变为慢性，并在牙龈形成瘘管。